鼓胀的病机主要是
A. 气机阻滞，瘀血内结
B. 肝脾肾受损，气滞血结，水停腹中
C. 脾肺肾功能失调，水潴体内
D. 心肝脾功能失常，水结腹内
E. 肝脾肾受损，血郁脾内

正确答案：B。肝脾肾受损，气滞血结，水停腹中

解析：鼓胀系肝脾肾三脏受损，气、血、水瘀积腹内所致。肝气郁结，气滞血瘀是形成鼓胀的基本条件，脾肾功能受损，水湿停聚为重要因素，其中气滞、血瘀、水停互为因果。气机阻滞，瘀血内结为积聚的病机（A错）。肝脾肾受损，气滞血结，水停腹中为鼓胀形成的病机（B对）。脾肺肾功能失调，水潴体内，无血瘀之征（C错）。心肝脾功能失常，水结腹内无血瘀之征（D错）。肝脾肾受损，血郁脾内无水停之征（E错）。